选择性中枢和外周5-HT₃受体的止吐药是
A. 甲氧氯普胺
B. 多潘立酮
C. 伊托必利
D. 莫沙必利
E. 格拉司琼

正确答案：E。格拉司琼

解析：本题考5-HT₃受体拮抗剂。格拉司琼（E对）是一种强效高选择性外周和中枢神经系统5-HT₃受体的阻断作用，抑制抗肿瘤药物和放疗引起的恶心和呕吐。甲氧氯普胺（A错）为中枢和外周D₂受体拮抗剂。多潘立酮（B错）为较强的外周性多巴胺D₂受体拮抗剂。伊托必利（C错）是D₂受体拮抗剂和乙酰胆碱脂酶抑制剂。莫沙必利（D错）为选择性5-HT₄受体激动剂。